左侧舌下神经受损时将出现
A. 舌后1/3一般感觉丧失
B. 舌内肌不瘫痪
C. 舌前2/3味觉丧失
D. 伸舌时舌尖偏向左侧
E. 舌后1/3味觉丧失

正确答案：D。伸舌时舌尖偏向左侧

解析：舌下神经含一般躯体运动纤维，支配同侧舌内肌和大部分舌外肌。因而左侧舌下神经受损时将出现左侧舌肌瘫痪（B错），伸舌时舌尖偏向左侧（D对）。舌后1/3一般感觉丧失（A错）、舌后1/3味觉丧失（E错）为舌咽神经分支受损的表现。舌前2/3味觉丧失（C错）为面神经分支受损的表现。